急性哮喘发作首选
A. 色甘酸钠吸入
B. 氨茶碱口服
C. 沙丁胺醇吸入
D. 麻黄碱口服
E. 倍氯米松口服

正确答案：C。沙丁胺醇吸入

解析：沙丁胺醇属于短效β2受体激动剂，为急性哮喘发作首选，给药方式为吸入给药。掌握“平喘药”知识点。